男性，52岁。渐起右上下肢抖动1年半，既往史无特殊。检查：血压150/95mmHg，神志清楚，表情呆板，右上下肢肌力正常，肌张力增高，呈齿轮样，在上下肢可见静止性震颤，余神经系统检查未发现异常。此患者合适的治疗为
A. 低分子右旋糖酐
B. 苯妥英钠
C. 左旋多巴
D. 泼尼松
E. 新斯的明

正确答案：C。左旋多巴